某单位调查了1000人的HBsAg的携带情况，其中45人阳性。该调查最合适的流行病学描述指标是
A. 死亡率
B. 发病率
C. 患病率
D. 感染率
E. 罹患率

正确答案：D。感染率